环境卫生工作和环境卫生学的任务是加强
A. 环境因素健康效应的研究
B. 环境与健康法律法规和标准体系建设
C. 农村环境卫生工作
D. 开拓环境与健康研究的新领域
E. 以上都是

正确答案：E。以上都是

解析：本题考查环境卫生工作和环境卫生学的任务。环境卫生工作和环境卫生学的任务包括：1.加强环境因素健康效应的研究；2.新技术、新方法在环境卫生工作中的应用；3.认真落实环境与健康法律法规要求，保护民众健康；4.加强农村环境卫生工作；5.开拓环境卫生工作的新领域（E对ABCD错）。